关于引发剂（启动剂）的特点，不正确的是
A. 引发剂本身具有致癌性
B. 引发剂可与DNA发生反应
C. 有可检测的阈剂量
D. 大多数是致突变物
E. 引发作用是不可逆的

正确答案：C。有可检测的阈剂量